关于原发性甲状腺功能减退症替代治疗，不正确的是
A. 从小剂量开始逐增至最佳剂量
B. 替代过程中需要定期监测
C. 替代用量应注意个体化
D. 确诊后即刻足量替代
E. TSH是评价疗效的最佳指标

正确答案：D。确诊后即刻足量替代

解析：原发性甲状腺功能减退症患者需要终身服用左甲状腺素（替代治疗），将血清TSH和甲状腺素水平恢复到正常范围，甲状腺功能减退症的替代治疗需要根据患者的心功能状况，心功能较差患者需从小剂量开始逐渐增至最佳剂量，防止诱发和加重心脏病（A对）。不可在确诊后立即足量替代（D错，为本题正确答案），50岁以上病人服用L-T₄前要常规检查心脏状态。一般从25～50μg/d开始，每1～2周增加25μg，直到达到治疗目标。小于50岁，既往无心脏病史病人可以尽快达到完全替代剂量。替代治疗过程中应注意定期检测，服用药物后，由于负反馈，建立下丘脑-垂体-甲状腺轴的平衡需要4～6周，因此每4～6周需要测定激素指标（B对）。针对不同人群用量应该注意个体化，成人L-T₄替代剂量为1.6～1.8μg/（kg·d）；老年病人则需要较低的剂量；儿童需要较高的剂量；妊娠时的替代剂量需要增加30%～50%；甲状腺癌术后的病人需要剂量较大（C对）。由于TSH变化最敏感，因此常以血TSH水平作为评价疗效的最佳指标（E对）。